患者，女，68岁，体重54kg，因慢性阻塞性肺病急性加重再次入院，入院后生化检查ALT20IU/L，血肌酐（Cr）1.8mg/dl，痰培养为铜绿假单胞菌，临床选用头孢他啶。查询头孢他啶药品说明书，成人常用剂量为1日1.5～6g，分2～3次给药；肌酐清除率为31～50ml/min时，剂量为每12小时lg；肌酐清除率为16～30ml/min时，剂量为每24小时1g；肌酐清除率为6～15ml/min时，剂量为每24小时0.5g；肌酐清除率为≤5ml/min时，剂量为每48小时0.5g；该患者头孢他啶的剂量应为
A. 每8小时2g
B. 每12小时lg
C. 每24小时0.5g
D. 每24小时1g
E. 每48小时0.5g

正确答案：D。每24小时1g

解析：本题考查头孢他啶的使用。成年男性的肌酐清除率计算公式：Ccr=（140-年龄）×体重/（72×Cr），成年女性的肌酐清除率为男性的0.85。患者，女，68岁，体重54kg，血肌酐（Cr）为1.8mg/dl，Ccr=（140-68）×54/（72×1.8）=30，该患者为女性，Ccr=30×0.85=25.5（ml/min），所以该患者Ccr为25.5（ml/min）。由题干给的已知条件：成人常用剂量为1日1.5～6g，分2～3次给药；肌酐清除率为31～50ml/min时，剂量为每12小时lg；肌酐清除率为16～30ml/min时，剂量为每24小时1g；肌酐清除率为6～15ml/min时，剂量为每24小时0.5g；肌酐清除率为≤5ml/min时，剂量为每48小时0.5g可得，该患者的肌酐清除率在16～30ml/min之间，该患者的给药剂量应为每24小时1g（D对）。